女，35岁，间断咳嗽、咳痰10余年，加重5天，每次发作均咳出大量脓性痰，5天前再次发作，并逐渐加重，X线检查：右下肺多发薄壁囊腔，部分可见液平。查体：右下肺可闻及湿啰音，该患者最可能的诊断是
A. 肺囊肿
B. 慢性肺脓肿
C. 肺包虫病
D. 支气管扩张
E. 纤维空洞性肺结核

正确答案：B。慢性肺脓肿

解析：患者有间断咳嗽、咳痰10余年（超过3个月）的病史，咳出大量脓性痰，X线检查：右下肺多发薄壁囊腔，部分可见液平，符合慢性肺脓肿（B对）的诊断。肺囊肿（A错）X线表现含液囊肿呈圆形、卵圆形块影，密度均匀一致，边缘整齐光滑。肺包虫病（C错）有流行区居住、工作、旅游或狩猎史，或与动物密切接触史，X线检查可见单发或多发边缘锐利的囊肿阴影。支气管扩张（D错）有反复咳脓痰、咯血病史和既往有诱发支气管扩张的呼吸道感染病史，X线检查可见支气管呈囊柱状扩张。纤维空洞性肺结核（E错）有低热、盗汗、乏力等结核中毒症状，X线检查可见纤维钙化影。